AMP在腺苷酸脱氨酶催化下脱去氨基，完成了氨基酸的脱氨基作用，在哪项组织中活性较强
A. 肝
B. 肾
C. 脑
D. 肌肉
E. 肺

正确答案：D。肌肉

解析：AMP在腺苷酸脱氨酶（此酶在肌肉组织中活性较强）催化下脱去氨基，最终完成了氨基酸的脱氨基作用。掌握“氨基酸及氨的代谢”知识点。